常先困脾的邪气是
A. 风
B. 燥
C. 湿
D. 寒
E. 火

正确答案：C。湿

解析：脾喜燥洁而恶湿浊，湿邪侵入人体，最易损伤脾阳，困遏脾气（C对）。风邪致病（A错）特点是风性轻扬开泄，易袭阳位；风性善行而数变；风性主动；风为百病之长。燥邪致病（B错）特点是燥性干涩，易伤津液；燥易伤肺。寒邪致病（D错）特点是寒为阴邪，易伤阳气；寒性凝滞凝滞，易使气血津液凝结、经脉阻滞；寒性收引。火邪致病（E错）特点是火热为阳邪，其性燔灼趋上；火热易扰心神；火热易伤津耗气；火热易生风动血"生风"；火邪易致阳性疮痈。